特发性血小板减少性紫癜较少出现
A. 肌肉血肿
B. 鼻出血
C. 月经过多
D. 口腔粘膜出血
E. 皮肤瘀点

正确答案：A。肌肉血肿

解析：特发性血小板减少性紫癜是由于患者对自身血小板抗原的免疫失耐受，产生体液免疫和细胞免疫介导的血小板过度破坏和血小板生成受抑，导致血小板数量减少，引起出血倾向，常见皮肤、黏膜出血如皮肤瘀点（E错）、瘀斑、鼻衄（B错）、口腔黏膜出血（D错）等，月经过多（C错）常见，其他内脏出血、肌肉血肿（A对）少见。